下列哪项不能做牙龈切除术
A. 牙龈组织增生肥大
B. 骨上袋的慢性脓肿
C. 后牙附着龈过窄的中等深度的骨上袋
D. 智齿冠周盲袋形成
E. 龈瘤

正确答案：C。后牙附着龈过窄的中等深度的骨上袋

解析：本题考查牙龈切除术的适应证。后牙附着龈过窄的中等深度的骨上袋（C错，为本题的正确答案）不能做牙龈切除术。牙龈组织增生肥大（A对）、骨上袋的慢性脓肿（B对）、智齿冠周盲袋形成（D对）、龈瘤（E对）、后牙中等深度的骨上袋均为牙龈切除术的适应症，但骨上袋，附着龈应有足够宽度，当其过窄时，不能做牙龈切除术。